用于估算透析清除率的是
A. NCCMERP标准
B. Cochrane分级
C. Cockroft-Gault公式
D. CLHD公式
E. Child-Turcotte-Pugh评分

正确答案：D。CLHD公式

解析：本题考查CLHD公式。用于估算透析清除率（CLHD）（D对）的公式如下：CLHD=Q（Ci-C₀）/Ci，式子中，Q表示出透析器的血流量；Ci表示入透析器时某药的血浓度；C₀表示出透析器时某药的血浓度。NCCMERP标准（A错）用于用药错误分级，我国目前尚无官方发布的用药错误分级标准，实际工作中通常借鉴美国国家用药错误报告及预防协调委员会制定的分级标准，即根据用药错误发生程度和发生后可能造成危害的程度，将用药错误分为A～I九级。Cochrane分级（B错）用于循证医学评价证据强弱分级。Cockroft-Gault公式（C错）用于评估CHF患者肾功能与死亡率的关系。Child-Turcotte-Pugh评分(E错）用于评价终末期肝病肝脏储备功能的进展。